一项病例对照研究，探讨妊娠期母亲的各种暴露史与新生儿先天性畸形之间的联系。在调查时，那些生畸形孩子的母亲由于心理压力常常隐瞒怀孕时的吸烟情况，而那些对照组儿童的母亲，其报告就较准确。如果上述情况确实存在，并且吸烟确实增加生畸形儿的危险，那么研究结果估计的相对危险度与真实的危险度相比是
A. 相同
B. 高估
C. 低估
D. 颠倒
E. 不能确定

正确答案：C。低估